急性黄疸型肝炎，黄疸前期最突出的症状是
A. 呼吸道症状
B. 神经系统症状
C. 消化道症状
D. 精神症状
E. 皮肤症状

正确答案：C。消化道症状

解析：急性黄疸型肝炎黄疸前期有非特异的前驱症状，与短暂的病毒血症相应的低热，关节酸痛，常误诊为上呼吸道感染。同时有不适、疲乏，突出症状是食欲不振、恶心呕吐（消化道症状）（C对）。黄疽前期可发生肝外病变和血清病样综合征：关节痛和关节炎、荨麻疹和血管神经性水肿、血管炎性病变、肾脏病变、紫癜、浆液膜炎、心肌炎、胰腺炎等。